男性患者，56岁，行上颌第三磨牙拔除，注射麻药后出现恶心、呕吐，可能的原因是
A. 慢性咽炎
B. 腭前神经麻痹
C. 腭后神经麻痹
D. 上牙槽神经麻痹
E. 以上都不是

正确答案：C。腭后神经麻痹

解析：本题考查腭前神经阻滞麻醉时出现恶心、呕吐的原因。根据题干，麻醉上颌第三磨牙腭侧，需麻醉腭前神经（B错），但应注意操作细节，注射麻药不可过量，注射点不可偏后，以免同时麻醉腭中、腭后神经（C对），引起软腭、腭垂麻痹不适而致恶心或呕吐。慢性咽炎（A错）有恶心症状，但此症状与拔牙无关，一直存在，不会在麻醉后突然出现。上牙槽神经麻痹（D错）会引起上颌牙的感觉麻痹，不会引起恶心、呕吐。